环境污染对人群健康影响的复杂性表现为
A. 环境污染物可通过多种形成和途径进入人体
B. 往往是多因素的联合作用
C. 人群处于低水平长时间暴露状况
D. 受污染影响人群的反应个体差异大
E. 以上都是

正确答案：E。以上都是

解析：本题考查环境污染对人群健康影响的复杂性。环境污染对人群健康影响的复杂性表现为：1.多样性：发生转移、富集和转化，通过多种环境介质，多种途径进入体内。2.复杂性：多因素的联合作用。3.长期性：低水平长时间。4.广泛性：受污染影响人群广，反应的个体差异大（E对ABCD错）。